一患者因车祸伤及颅面部，有一过性昏迷病史，急诊检查发现颧部凹陷，眶周瘀血，咬合正常，张口受限，应首先做哪项辅助检查
A. 头颅CT
B. 上颌骨华氏位片
C. 颧弓位片
D. 上颌咬合片
E. 鼻颏位片

正确答案：A。头颅CT

解析：本题考查颅面部损伤的辅助检查。一患者因车祸伤及颅面部，有一过性昏迷病史，急诊检查发现颧部凹陷，眶周瘀血，咬合正常，张口受限，应首先做头颅CT（A对）以了解颅脑损伤的情况，必要时会同神经外科医师共同诊治。对于伤情比较重并伴有昏迷的伤员，可能存在颅脑损伤，应及时拍摄CT或MRI以了解病情，待颅脑伤情平稳后再处理颌面伤。颧面部塌陷畸形、眶周淤血、张口受限为颧骨颧弓骨折表现，X线片检查常用鼻颏位（华氏位）和颧弓切线位。